与藜芦相反的药有
A. 白蔹
B. 苦参
C. 丹参
D. 细辛
E. 白芍

正确答案：B、C、D、E。苦参；丹参；细辛；白芍

解析：本题考查的是十八反的配伍禁忌。与藜芦相反的药有苦参（B对）、丹参（C对）、细辛（D对）与白芍（E对）。十八反列述了三组相反药，分别是：甘草反甘遂、京大戟、海藻、芫花；乌头（川乌、附子、草乌）反半夏、瓜蒌（全瓜蒌、瓜蒌皮、瓜蒌仁、天花粉）、贝母（川贝、浙贝）、白蔹（A错）、白及；藜芦反人参、南沙参、丹参、玄参、苦参、细辛、芍药（赤芍、白芍）。